苦泄寒清，力猛有毒，外用吹鼻能引去湿热的药
A. 斑蝥
B. 轻粉
C. 铅丹
D. 瓜蒂
E. 毛茛

正确答案：D。瓜蒂

解析：本题考查的是瓜蒂的性能特点。苦泄寒清，力猛有毒，外用吹鼻能引去湿热的药瓜蒂（D对）。瓜蒂：【性能特点】本品苦泄寒清，毒烈上涌力猛，唯入胃经。内服可涌吐热痰宿食，外用吹鼻能引去湿热。斑蝥（A错）：【性能特点】本品辛热散泄，毒剧力猛，入肝、胃、肾经。外用攻毒发疱蚀疮，治痈疽、顽癣、瘰疬。内服除攻毒外，又破血逐瘀、散结消癥，可治闭经、癥瘕。轻粉（B错）：【性能特点】本品辛寒燥烈，毒大力强，既入肾、肝经，又入大肠经。外用善攻毒杀虫敛疮，治疥癣梅毒、疮疡溃烂；内服能祛痰消积、逐水通便，治痰涎积滞、水肿鼓胀。铅丹（C错）：【性能特点】本品辛散涩敛，微寒能清，质重镇坠，有毒力强，入心、肝经。外用善拔毒收湿而止痒、生肌敛疮。内服虽能坠痰镇惊、攻毒截疟，但因毒大，现较少用。毛茛（E错）：【性能特点】本品辛散燥烈，毒大温灼，只作外用，功能发泡止痛、攻毒杀虫，外治多种痛症，以及疮痈、疟疾、癣癞等。